孕前指导
A. 新婚阶段双方在性交时心情都比较紧张，又缺乏实践经验，选择的避孕方法要求简便易行
B. 婚后短期内性交时女方阴道内外组织较紧，影响某些外用避孕药具的置入及放置部位
C. 所用避孕方法停用后应不影响生育功能和下一代健康
D. 做好孕前准备，包括受孕时机、受孕季节的选择、夫妇双方的健康、心理、环境等因素的准备，同时要消除不利受孕因素的影响如戒烟、戒酒、避免有害物理化学因素的接触
E. 以上均是

正确答案：E。以上均是

解析：本题考查孕前指导的相关内容。新婚阶段双方在性交时心情都比较紧张，又缺乏实践经验，选择的避孕方法要求简便易行。婚后短期内性交时女方阴道内外组织较紧，影响某些外用避孕药具的置入及放置部位。所用避孕方法停用后应不影响生育功能和下一代健康。做好孕前准备，包括受孕时机、受孕季节的选择、夫妇双方的健康、心理、环境等因素的准备，同时要消除不利受孕因素的影响如戒烟、戒酒、避免有害物理化学因素的接触等（E对ABCD错）。